癌症疼痛的治疗，应按照疼痛的不同程度选用不同阶段的镇痛药物，下列属于第三阶梯的镇痛物质是
A. 双氯芬酸
B. 塞来昔布
C. 可待因
D. 布桂嗪
E. 吗啡

正确答案：E。吗啡

解析：本题考查不同阶梯的止痛药物。（1）第一阶梯：非阿片类药物，多指 NSAIDs，对具有“封顶效应”（天花板效应）。（2）第二阶梯：弱阿片类药物，如可待因、二氢可待因、曲马多等。（3）第三阶梯：强阿片类药物，以吗啡为代表，药物种类及剂型多样，合理使用将使90%以上的中至重度疼痛患者减轻症状，无封顶效应。主要药物有吗啡（有多种剂型，如注射剂、即释片、缓释片）、芬太尼注射剂或透皮贴剂、美沙酮、哌替啶、二氢埃托啡、羟考酮。双氯芬酸（A错）、塞来昔布（B错）为第一阶梯的止痛药物，可待因（C错）、布桂嗪（D错）为第二阶梯的止痛药物，吗啡（E对）为第三阶梯的止痛药物。